下列哪项不属于吸气性呼吸困难
A. 喉头水肿
B. 气管受压
C. 气管异物
D. 支气管哮喘
E. 喉癌

正确答案：D。支气管哮喘

解析：吸气性呼吸困难表现为吸气显著费力，严重者吸气时可见“三凹征”，表现为胸骨上窝、锁骨上窝和肋间隙明显凹陷，此时亦可伴有干咳和高调性喉鸣。三凹征的出现主要是由于呼吸肌极度费力，胸腔负压增加所致，常见于气道狭窄与阻塞。气管受压（B对）、气管异物（C对）均可导致气管狭窄，因此二者引起的呼吸困难属于吸气性呼吸困难。喉头水肿（A对）、喉癌（E对）均可以导致喉部狭窄，因此二者导致的呼吸困难属于吸气性呼吸困难。支气管哮喘（D错，为本题正确答案）是气管慢性炎症，其导致的呼吸困难是呼气性呼吸困难。